关于眼膏剂的说法，错误的是
A. 供眼用的无菌制剂
B. 用于眼部手术的眼膏剂不得加入抑菌剂
C. 常用1:1:8的黄凡士林、液体石蜡和羊毛脂的混合物作为基质
D. 难溶性药物制备眼膏剂时，应先研成极细粉并通过九号筛
E. 眼膏剂的缺点是有油腻感并使视力模糊

正确答案：C。常用1:1:8的黄凡士林、液体石蜡和羊毛脂的混合物作为基质

解析：本题考查眼膏剂的定义和制备。眼膏剂常用8:1:1的黄凡士林、液体石蜡和羊毛脂的混合物作为基质（C错，为本题正确答案），是供眼用的无菌制剂（A对），其中用于眼部手术的眼膏剂不得加入抑菌剂（B对），难溶性药物制备眼膏剂时需粉碎过九号筛以减少对眼睛的刺激（D对），眼膏剂的缺点是有油腻感并使视力模糊（E对）。